中枢性尿崩症，为减少尿量的首选治疗是
A. 加压素水剂长期替代
B. 每天肌肉注射油剂鞣酸加压素
C. 口服去氨加压素替代
D. 加压素水剂与双氢克尿噻合用
E. 非激素类抗利尿药物

正确答案：C。口服去氨加压素替代

解析：中枢性尿崩症（P673）患者，AVP（精氨酸加压素）的合成、转运、储存及释放受到影响，导致其血中AVP浓度下降。由于其尿量增多的原因为精氨酸加压素缺乏，因此为减少尿量应补充精氨酸加压素或其类似物。去氨加压素（C对）是人工合成的加压素类似物，抗利尿作用强，且不良反应较少，为目前治疗尿崩症的首选药物。不同去氨加压素制剂可有不同服用方式，口服去氨加压素替代、鼻腔喷雾吸入或肌内注射制剂替代均可（P675）。加压素水剂即垂体后叶素水剂（P675）（AD错）需注射治疗，口服无效，且每次注射维持作用时间较短，每日需多次注射，不便长期应用，主要用于颅脑外伤或术后神志不清的尿崩症患者。油剂鞣酸加压素注射液（P675）（B错）注射后维持时间较长，可减少频繁注射的麻烦，但是长期应用两年左右会因产生抗体而减效，注射过量会引起水中毒。氢氯噻嗪（D错）为肾性尿崩症的主要治疗药物。非激素类抗利尿药物（E错）如氯磺丙脲（P675）、卡马西平等，可刺激AVP释放并增强AVP对肾小管的作用，但抗利尿作用不及去氨加压素，临床上不作为首选药物。